下列哪项检查阳性表示乙型肝炎患者传染性强
A. HBsAg
B. 抗-HBs
C. HBeAg
D. 抗-HBe
E. 抗-HBc

正确答案：C。HBeAg

解析：乙型肝炎患者和无症状携带者是乙肝的传染源，HBeAg（C对）为HBV感染后出现的血清学标志，是病毒复制的重要指标，其阳性提示传染性强；HBsAg（A错）是HBV感染的血清学标志，其阳性提示为乙肝患者或携带者；抗-HBs、抗-HBe、抗-HBc是三种抗体，不具传染性，其阳性提示病情好转。